兼补胃，肾之兼的药物是
A. 鳖甲
B. 石斛
C. 百合
D. 北沙参
E. 何首乌

正确答案：B。石斛

解析：本题考查药物的性味归经。补益药性味多甘，兼补胃，肾之兼的药物性味甘，且入胃经与肾经。石斛性味甘、寒，且入胃、肾经，入胃经，治疗胃阴不足，食少干呕；入肾经，治疗肾阴亏虚，目暗不明，筋骨萎软（B对）；鳖甲归肝、肾经，多用来补益肝、肾之阴（A错）；百合入心、肺经，能养阴清肺，润燥止咳，养阴清心，宁心安神（C错）；北沙参入肺、胃经，能养肺、胃之阴，清肺、胃之热（D错）；何首乌入心、肝、肾经，益精血，养肝肾之阴（E错）。